队列研究的研究对象是
A. 患某病的人群
B. 健康人群
C. 具有暴露因素的人群
D. 患某病且具有暴露因素的人群
E. 未患某病而有暴露因素的人群

正确答案：E。未患某病而有暴露因素的人群